适宜用泛制法制备的是
A. 浓缩丸
B. 大蜜丸
C. 水丸
D. 胶丸
E. 滴丸

正确答案：C。水丸